药物在体内的平均滞留时间计算公式是
A. MRT=AUMC/AUC
B. Css=K₀/KV
C. fss=1-e-kt
D. C=K₀（1-e-kt）/KV
E. E=dXu/dt=ke·X₀e-kt

正确答案：A。MRT=AUMC/AUC

解析：本题考查统计矩分析在药动学中的应用。MRT=AUMC/AUC（A对）为药物在体内的平均滞留时间即一阶矩的公式；Css=K₀/KV（B错）为静脉滴注稳态血药浓度的公式；fss=1-e-kt（C错）为达到稳态血药浓度时的达坪分数；C=K₀（1-e-kt）/KV（D错）为单室模型静脉滴注给药，体内药量X或血药浓度C与时间t的关系式；E=dXu/dt＝ke·X₀e-kt（E错）为尿排泄速度与时间的关系公式。